影响过滤效果的因素是
A. 滤速、进水水质、滤池类型、滤层厚度和粒径
B. 滤速、进水水量、滤池类型、滤层厚度和粒径
C. 滤速、出水水质、滤池类型、滤层厚度和粒径
D. 滤池、出水水量、滤过大小、滤层厚度和粒径
E. 滤速、进水水质、滤池大小、滤层厚度和粒径

正确答案：A。滤速、进水水质、滤池类型、滤层厚度和粒径

解析：本题考查过滤效果的影响因素。影响过滤效果的因素主要有：1.滤层厚度和粒径：滤层过薄，水中悬浮物会穿透滤料层而影响出水水质；过厚会延长过滤时间。滤料粒径大，筛滤、沉淀杂质的作用小；2.滤速：是指水流通过过滤层整个面积的速度。滤速过快会影响滤后水质，滤速过慢过滤效果好，但会影响出水量。3.进水水质：进水的浑浊度、色度、有机物、藻类等对过滤效果影响很大，其中影响最大的是进水的浊度，要求浊度低于10度。④滤池类型：慢滤池因滤料粒径小，过滤效果好，去除微生物的效果一般在99%以上。而快滤池一般在99%以下，有时甚至远低于90%（A对BCDE错）。